哪一项不是阿司匹林的不良反应
A. 胃溃疡及无痛性胃出血
B. 出血时间延长
C. 溶血性贫血
D. 诱发哮喘
E. 血管神经性水肿

正确答案：C。溶血性贫血

解析：阿司匹林不良反应：①胃肠道反应最为常见。②加重出血倾向。③水杨酸反应。④过敏反应：少数患者可出现荨麻疹、血管神经性水肿和过敏性休克。某些哮喘患者服用阿司匹林或其他解热镇痛药后可诱发哮喘，称为“阿司匹林哮喘”。⑤瑞夷综合征。⑥对肾脏的影响。　掌握“阿司匹林”知识点。